男性，42岁。3天来右上后磨牙痛重，冷热加剧，夜间痛而来就诊。近1年多来，右上磨牙进食时咬到某特定位置时出现撕裂样痛，冷热敏感，平时咬物不适。检查：16咬合面似有近远中方向越过边缘嵴的细裂纹，颊尖高陡，无龋洞，不松动，叩痛（+）。治疗方案为
A. 充填术+调（牙合）
B. 盖髓术+调（牙合）+全冠修复
C. 塑化治疗+全冠修复
D. 根管治疗+调（牙合）
E. 根管治疗+调（牙合）+全冠修复

正确答案：E。根管治疗+调（牙合）+全冠修复

解析：本题考查隐裂的治疗。①对因治疗：调除创伤性咬合力，调磨过陡的牙尖；均衡全口咬合力的负担；诊治其他部位的牙齿疾病，修复缺失牙等。②对症治疗：出现并发症时进行相应治疗。③防止劈裂：在做牙髓治疗前，应先对患牙予以降（牙合）处理，并磨除牙冠裂纹后用复合树脂粘接；或用钢丝结扎、带环或临时冠保护，防止牙髓治疗过程中牙冠劈裂；牙髓治疗过程应尽量一次完成，缩短时间，减少术中劈裂的风险；牙髓治疗后，行永久充填修复。总之，治疗方案为根管治疗+调（牙合）+全冠修复（E对）。